可摘局部义齿固位力的调节中，哪项不正确
A. 用锻丝卡增加纵向固位力
B. 调整就位道
C. 调整固位臂进入倒凹的深度
D. 增加直接固位体数日，一般2～4个
E. 调整基牙上固位体的固位形，倒凹深度小于1mm，坡度大于20°

正确答案：A。用锻丝卡增加纵向固位力

解析：需纵向固位力强者，可用铸造卡环；需横向固位力强者，可用锻丝卡环。掌握“局部义齿人工牙及基托”知识点。